流行性结膜炎可选用
A. 色甘酸钠滴眼液
B. 七叶洋地黄双苷滴眼液
C. 玻璃酸钠滴眼液
D. 氧氟沙星滴眼液
E. 碘苷滴眼液

正确答案：E。碘苷滴眼液

解析：本题考查流行性结膜炎用药。碘苷滴眼液（E对）可用于治疗流行性结膜炎。对流行性结膜炎局部给予抗病毒药，非处方药可选用酞丁安或阿昔洛韦滴眼液；处方药可用0.1%碘苷滴眼液。色甘酸钠滴眼液（A错）可用于治疗过敏性结膜炎和春季卡他性结膜炎。氧氟沙星滴眼液（D错）用于急性卡他性结膜炎未彻底治愈而转变为慢性结膜炎者，由细菌所致的结膜炎。玻璃酸钠滴眼液（C错）可用于干眼症。局部使用七叶洋地黄双苷滴眼液（B错）改善睫状肌功能和增加睫状肌血流量以改善眼部调节功能，减轻眼部不适。